脾胃虚弱，痞满反复发作者，治法宜首选
A. 清热化湿，和胃消痞
B. 理气宽胸，补泻并用
C. 疏肝解郁，和胃消痞
D. 补气健脾，升清降浊
E. 和胃降气，消痞开结

正确答案：D。补气健脾，升清降浊

解析：本题胃痞患者由于脾胃虚弱，升降失常，故应补气健脾，升清降浊（D对）应当使用补中益气汤。清热化湿，和胃消痞（A错）为湿热蕴胃证，应当用黄连温胆汤清化湿热。疏肝解郁，和胃消痞（C错）对应肝郁气滞证，当使用越鞠丸和枳术丸，而十版书中无理气宽胸，补泻并用（B错）的治法，但可见于枳实消痞丸。和胃降气，消痞开结（E错）十版书中未提及，但可见旋覆代赭汤。